对革兰阳性菌作用强，对革兰阴性菌作用弱的药物是
A. 第一代头孢菌素
B. 第二代头孢菌素
C. 第三代头孢菌素
D. 第四代头孢菌素
E. 碳青霉烯类抗生素

正确答案：A。第一代头孢菌素

解析：本题考查头孢菌素。第一代头孢菌素（A对）对革兰阳性菌作用较第二代强，显著超过第三代，对革兰阴性杆菌较第二、三代弱。第二代头孢菌素（B错）对革兰阳性菌的抗菌活性较第一代略差或相仿，对革兰阴性菌的抗菌活性较第一代强，较第三代弱。第三代头孢菌素（C错）对革兰阳性菌较第一、二代弱，对革兰阴性菌较强。第四代头孢菌素（D错）与第三代相比，增强了抗革兰阳性菌活性。碳青霉烯抗生素（E错）对革兰氏阳性菌、阴性菌及厌氧菌都有强大的抗菌活性。